治疗痫病风痰闭阻证，应首选
A. 定痫丸
B. 涤痰汤
C. 顺气导痰汤
D. 生铁落饮
E. 羚角钩藤汤

正确答案：A。定痫丸

解析：痫病风痰闭阻证是由痰浊素盛，肝阳化风，痰随风动，风痰闭阻，上干清窍所致。治疗宜涤痰熄风，开窍定痫，代表方为定痫丸（A对）。龙胆泻肝汤合涤痰汤功能清热泻火，化痰开窍，为治疗痫病痰火扰神证的选方（B错）。顺气导痰汤功能涤痰开窍，常合逍遥散治疗癫狂癫证之痰气郁结证（C错）。生铁落饮功能清心泻火，涤痰醒神，为治疗癫狂狂证之痰火扰神证的选方（D错）。羚角钩藤汤功能平肝潜阳息风，可治疗厥证血厥实证（E错）。